左心衰患者出现劳力性呼吸困难的机制是
A. 体力活动时部分血液转移到躯体下半部，回心血量减少
B. 体力活动时隔肌位置相对下移
C. 体力活动时机体需氧增加
D. 体力活动时迷走神经相对兴奋
E. 体力活动时神经反射敏感性降低

正确答案：C。体力活动时机体需氧增加

解析：左心衰患者的呼吸困难在早期表现为劳力性呼吸困难。患者体力活动时，①四肢血流量增加，回心血量增加（A错），肺淤血加重。②心率增快，使心脏舒张期缩短，心室充盈不足，肺淤血加重。③机体需氧增加（C对），但衰竭的心室无法提高心排血量，导致机体缺氧进一步加重，出现呼吸困难。